女，65岁。经常出现头晕四肢麻木感，注意力不易集中，自感记忆力下降半年，近2周突然加重。常半夜起床翻东西，怀疑家中被窃，易哭泣，对一些物品不能命名。高血压病史15年。头颅CT示：多发性脑梗死。最可能的诊断是
A. 阿尔茨海默病
B. 血管性痴呆
C. 轻度认知功能损害
D. 高血压病伴精神障碍
E. 匹克病

正确答案：B。血管性痴呆

解析：该患者老年女性，经常出现头晕四肢麻木感（头部血供不足），注意力不易集中，自感记忆力下降半年，近2周突然加重，出现行为精神异常及认知障碍，有脑血管病的高危因素高血压15年，头颅CT示：多发性脑梗死。综上，应诊断为血管性痴呆（B对）。血管性痴呆是血管性认知障碍认知损害程度已达痴呆的一种类型，多在60岁以后发病，病程呈波动性进展（P209），CT检查常有脑梗死灶或出血灶（P228）。阿尔茨海默病（A错）与血管性痴呆在临床表现上有不少类似之处，阿尔茨海默病认知障碍突出，自觉症状较少，且CT显示为脑皮质萎缩（P219）。轻度认知功能损害（C错）无明显的淡漠、焦虑等精神症状。高血压病伴精神障碍（D错）记忆下降等认知障碍表现不突出。匹克病（E错）是始于中年的进行性痴呆，人格障碍、社会行为障碍、言语功能受损出现较早而记忆减退等认知障碍表现较晚，CT表现主要为显著的额叶和（颞）叶萎缩。